胚胎第三周，前脑的下端出现的突起是
A. 额鼻突
B. 下颌突
C. 上颌突
D. 中鼻突
E. 球状突

正确答案：A。额鼻突

解析：面部的发育始于胚胎第3周，此时前脑的下端出现额鼻突。掌握“面部的发育”知识点。